男性，50岁，阵发性腹痛，腹胀，呕吐，无排便排气5天，2年前，有阑尾手术史，查体，腹膨隆，可见肠型，有压痛，肠音亢进，腹部X线平片见中下腹部小肠有数个液气平面，盲肠、升结肠肠腔扩张，下列各病中以哪种可能性最大
A. 机械性肠梗阻
B. 麻痹性肠梗阻
C. 高位小肠梗阻
D. 低位小肠梗阻
E. 绞窄性肠梗阻

正确答案：A。机械性肠梗阻

解析：中年男性患者，既往有阑尾手术史，阵发性腹痛、腹胀、呕吐、无排便排气5天（肠梗阻的典型临床表现），查体：腹膨隆，可见肠型，有压痛，肠音亢进（机械性肠梗阻的典型体征），腹部X线平片见中下腹部小肠有数个液气平面，盲肠、升结肠肠腔扩张，根据患者的病史、临床症状及体征，考虑最可能的诊断为机械性肠梗阻（A对），麻痹性肠梗阻（B错）不是阵发性腹痛，而是持续性胀痛或不适，听诊时肠鸣音减弱或消失。绞窄性肠梗阻（E错）腹痛发作急骤，初始即为持续性剧烈疼痛，腹部X线检查见孤立扩大的肠袢。  高位小肠梗阻（C错）的呕吐发生早而频繁，腹胀不明显；低位小肠梗阻（D错）的腹胀明显，呕吐出现晚而次数少，并可吐粪样物，根据现有症状并不能确定是高位还是低位。